下述关于口腔前庭沟的叙述中哪项是错误的
A. 又称唇颊龈沟
B. 为口腔前庭的上、下界
C. 为唇、颊粘膜移行于牙槽粘膜的沟槽
D. 前庭沟粘膜下组织致密
E. 是口腔局麻常用的穿刺及手术切口的部位

正确答案：D。前庭沟粘膜下组织致密

解析：前庭沟粘膜下组织松软，是口腔局麻常用的穿刺及手术切口的部位。掌握“口腔境界及唇、颊的局部解剖”知识点。